下列哪种是减毒活疫苗
A. 鼠疫菌苗
B. 伤寒菌苗
C. 百日咳菌苗
D. 类毒素
E. 森林脑炎疫苗

正确答案：A。鼠疫菌苗